C-3位含有季铵基团，能迅速穿透细菌细胞壁的药物是
A. 头孢氨苄
B. 头孢克洛
C. 头孢呋辛
D. 硫酸头孢匹罗
E. 头孢曲松

正确答案：D。硫酸头孢匹罗

解析：本题考查头孢菌素类抗菌药。头孢匹罗（D对）含有正电荷的季铵基团，能迅速穿透细菌的细胞壁，对大多数的革兰阳性菌和革兰阴性菌产生高度活性。头孢氨苄（A错）的C-3位乙酰氧甲基换成甲基，可在酸性条件下稳定。头孢克洛（B错）的C-3位取代为氯原子。头孢呋辛（C错）的C-3位取代为氨基甲酸酯。头孢曲松（E错）的C-3位上引入酸性较强的杂环。